两种化学物质的毒性比单独化学物质的毒性大，但引起动物中毒效应不是两种毒物类加的结果称为
A. 相加作用
B. 协同作用
C. 独立作用
D. 拮抗作用
E. 综合作用

正确答案：C。独立作用

解析：本题考查独立作用。两种化学物质的毒性比单独化学物质的毒性大，但引起动物中毒效应不是两种毒物累加的结果称为独立作用（C对ABDE错）。